男，50岁。口腔内起白斑。检查：口腔内左侧黏膜及腭上灰白色光滑而微隆起的斑块，双侧前臂散在性玫瑰红色斑疹。低烧，头痛。患者自述阴茎部曾有过溃疡，已痊愈。该病初步印象是
A. 盘状红斑狼疮
B. 多形性红斑
C. 扁平苔藓
D. 口腔白斑
E. 梅毒

正确答案：E。梅毒

解析：本题考查梅毒的临床表现。梅毒是由梅毒螺旋体引起的一种慢性性传播疾病，梅毒螺旋体可侵犯人体几乎所有器官，因此梅毒的临床表现复杂多样。口腔内左侧黏膜及腭上灰白色光滑而微隆起的斑块为梅毒粘膜斑的表现，阴茎部曾有过溃疡，这是一期梅毒硬下疳的表现，双侧前臂散在性玫瑰红色斑疹为梅毒疹的表现，同时伴有低烧头痛，因此考虑诊断为梅毒（E对）。盘状红斑狼疮（A错）、多形性红斑（B错）、扁平苔藓（C错）和口腔白斑（D错）均不会有阴茎溃疡史。